医患双方因诊疗活动引发的争议，称为
A. 医疗事故
B. 医疗纠纷
C. 医疗责任
D. 医疗风险
E. 医疗方案

正确答案：B。医疗纠纷

解析：医疗纠纷，是指医患双方因诊疗活动引发的争议。